关于晚期肺癌压迫侵犯邻近器官、组织或远处转移时，下列征象不正确的是
A. 侵犯膈神经，引起同侧膈肌麻痹
B. 侵犯喉返神经，引起声带麻痹，声音嘶哑
C. 骨关节病综合征
D. 侵犯胸膜，引起胸膜腔积液
E. 侵入纵隔，压迫食管，引起吞咽困难

正确答案：C。骨关节病综合征

解析：晚期肺癌压迫侵犯邻近器官、组织，或远处转移时，可产生一系列症状和体征，如侵犯膈神经，引起同侧膈肌麻痹（A对）；侵犯喉返神经，引起声带麻痹，声音嘶哑（B对）；侵犯胸膜，引起胸膜腔积液（D对）；侵犯纵隔，压迫食管，引起吞咽困难（E对）等。骨关节病综合征（C错，为本题正确答案）为副瘤综合征的表现（由于肿瘤产生内分泌物质，临床上呈现出非转移性的全身症状），不是肺癌的侵犯或远处转移征象。